白茅根具有的功效是
A. 解毒敛疮
B. 消肿生肌
C. 清热利尿
D. 祛痰止咳
E. 活血祛瘀

正确答案：C。清热利尿

解析：该题考查白茅根的功效。白茅根味甘，性寒，归肺、胃、膀胱经，其功效为凉血止血，清热利尿，清肺胃热（C对）。